关于口腔正常菌群的作用的描述，错误的是
A. 刺激宿主免疫系统
B. 作为生物屏障，抑制外源微生物
C. 维持口腔或全身（如消化道）微生物的生态平衡
D. 营养功能
E. 为外源性感染提供条件

正确答案：E。为外源性感染提供条件

解析：本题考查口腔正常菌群的作用。为外源性感染提供条件（E错，为本题的正确答案）不是口腔正常菌群的作用。口腔正常菌群可以刺激宿主免疫系统（A对）、作为生物屏障，抑制外源微生物（B对）、维持口腔或全身（如消化道）微生物的生态平衡（C对）、发挥营养功能（D对）如有些细菌会产生维生素K等。